与细菌耐药性有关的结构是
A. 性菌毛
B. 荚膜
C. 质粒
D. 鞭毛
E. 异染颗粒

正确答案：C。质粒